不是人工负压吸引术禁忌证的是
A. 宫腔压力大者
B. 生殖道炎症，患盆腔炎者
C. 高血压患者
D. 高热患者
E. 严重贫血者

正确答案：A。宫腔压力大者

解析：人工负压吸引术禁忌证是：①生殖器官急性炎症（B对）。②各种疾病的急性期，或严重的全身性疾病不能耐受手术者。③术前两次体温高于37.5℃者（D对）。高血压患者（C对）、严重贫血者（E对）为严重的全身性疾病不能耐受手术。宫腔压力大（A错，为本题正确答案）不是人工负压吸引术禁忌证。